以温和噬菌体为载体，受体菌获供体菌遗传物质而获得新的性状称为
A. 转化
B. 转导
C. 溶原性转换
D. 接合
E. 原生质体融合

正确答案：B。转导